黄滑苔的临床意义是
A. 湿热痰热内蕴，食积化腐
B. 阳虚寒湿内盛，痰饮内停
C. 阳虚寒湿之体，痰饮化热
D. 素有湿浊宿食，阻滞气机
E. 气血亏虚之体，痰饮食积

正确答案：C。阳虚寒湿之体，痰饮化热

解析：苔淡黄而润滑者，称黄滑苔，多为寒湿、痰饮聚久化热，或为气血亏虚，复感湿热之邪所致（C对）。黄苔而质腻者，称黄腻苔，主湿热或痰热内蕴，或为食积化腐（A错）。阳虚寒湿内盛，痰饮内停为舌白，苔灰黑润滑（B错）。素有湿浊宿食，阻滞气机为腻苔（D错）。气血亏虚之体，痰饮食积为舌淡苔腻（E错）。